男，10岁，发热10天，体温38～39℃，刺激性咳嗽明显，胸痛。查体：双肺散在干啰音，胸片：左肺下野淡薄片状阴影。为确诊，首选的检查是
A. 血培养
B. 结核菌素试验
C. 冷凝集试验
D. 血肥达氏反应
E. 痰液病毒分离

正确答案：C。冷凝集试验

解析：该患者为男性儿童（支原体肺炎的好发年龄），发热10天，体温38-39℃，刺激性咳嗽明显，胸痛。查体：双肺散在干啰音，胸片：左肺下野淡薄片状阴影（支原体肺炎的典型胸片改变），根据临床表现及辅助检查可初步诊断为支原体肺炎。支原体肺炎的患者起病2周后，约2/3的患者冷凝集试验阳性，滴度≥1：32，如果滴度逐步升高，则更有诊断价值，所以确诊首选的检查是冷凝集试验（C对）。血培养（A错）用于确定细菌性肺炎的病原菌，该患者考虑为支原体感染，支原体血培养率很低，故不作为首选的检查。结核菌素试验（B错）用于确定结核杆感染，该患者没有低热、盗汗等结核毒血症的表现，故不作为首选检查。血肥达氏反应（D错）用于确定伤寒杆菌感染。痰液病毒分离（E错）用于确定病毒性肺炎的病原菌。